男性，18岁，2个月前，因急性脓胸经多次胸腔穿刺抽脓及抗菌治疗后，仍有低热、消瘦，胸部X线片示右胸仍可见有包裹性脓腔，入院后行胸腔闭式引流术，每日引流脓液30—50ml，胸片及胸部CT显示右下胸部有。10cm×6cm残腔，壁厚约2mm，未见钙化，肺内未见病变，进一步治疗应选择
A. 继续改进胸腔引流
B. 将闭式引流改为开放引流
C. 胸膜纤维板剥除术
D. 胸膜肺切除术
E. 改进全身情况，消除中毒症状和营养不良

正确答案：C。胸膜纤维板剥除术

解析：患者有急性脓胸病史2个月，迁延不愈，胸片及胸部CT显示右下胸部有10cm×6cm腔，壁厚约2mm，未见钙化，考虑胸膜已有纤维性增厚，诊断为慢性脓胸。改进引流手术用于初期或大手术前的准备措施。改进全身情况，消除中毒症状和营养不良，只作为支持措施。患者胸膜与肺组织粘连不太紧密，肺组织尚未纤维化，肺内未见病变，宜行胸膜纤维板剥除术，最大限度回复肺功能，不宜行胸膜肺切除术。故选C。掌握“脓胸”知识点。